在大于70岁的人中，虽然冠心病的发病率随着年龄增长而增高，但该病的患病率下降，这种现象的最好解释是
A. 大于70岁的人冠心病患者病程较短
B. 大于70岁的人冠心病患者病程较长
C. 大于70岁的人冠心病患者有较好的治疗措施
D. 大于70岁的人冠心病的病死率降低
E. 大于70岁的人冠心病的发病减少

正确答案：A。大于70岁的人冠心病患者病程较短